语言謇涩，病因多为
A. 热扰心神
B. 痰火扰心
C. 风痰阻络
D. 心气不足
E. 心阴大伤

正确答案：C。风痰阻络

解析：语謇指神志清楚，思维正常，但语言不流利，或吐字不清者。因习惯而成者称为口吃，不属病态。病中语言謇涩，每与舌强并见者，多因风痰阻络所致，为中风之先兆或中风后遗症。（C对）。热扰心神（A错）可见于谵语，表现为神识不清，语无伦次，声高有力，属实证。痰火扰心（B错）可见于狂言，表现为精神错乱，语无伦次，狂躁妄言。心气不足（D错）可见于独语，表现为自言自语，喃喃不休，见人语止，首尾不续。心阴大伤（E错）可见于郑声，表现为神识不清，语言重复，时断时续，语声低弱模糊。